男，47岁。因腹痛4小时于急诊诊断为“重症急性胰腺炎”。入院后给予禁食补液及抗感染治疗。2天后患者逐渐感觉气短。查体：T38.3℃，R31次/分，BP110/75mmHg。双肺呼吸音清晰，心率96次/分，P₂＜A₂，未闻及杂音及附加音。腹部压痛（+）。经皮氧饱和度监测示SpO₂由95%逐渐下降至88%。该患者首先考虑的诊断是
A. 医院获得性肺炎
B. 心力衰竭
C. 急性呼吸窘迫综合征
D. 阻塞性肺不张
E. 肺栓塞

正确答案：C。急性呼吸窘迫综合征

解析：患者为中年男性，诊断为重症急性胰腺炎（是急性呼吸窘迫综合征的常见危险因素），2天后逐渐出现气短，心肺查体未见异常，经皮氧饱和度监测示SpO₂由95%逐渐下降至88%（出现顽固性低氧血症，为急性呼吸窘迫综合征的典型症状之一），根据其临床表现和辅助检查，考虑诊断为急性呼吸窘迫综合征（C对）。医院获得性肺炎（P42）（A错）是指患者入院时不存在，也不处于潜伏期，而于入院48小时后在医院发生的肺炎，主要症状为寒战、高热、咳嗽，肺实变时有典型的体征，如叩诊浊音、语颤增强和闻及支气管呼吸音等。急性左心衰竭（P174-P175）（B错）多为中老年患者，有高血压、冠状动脉粥样硬化性心脏病、风湿性心脏病等病史和体征，突发气急，端坐呼吸，阵发性咳嗽，常咳出粉红色泡沫痰，两肺可闻及广泛的湿啰音和哮鸣音，左心界扩大，心率增快，心尖部可闻及奔马律。阻塞性肺不张（D错）主要原因是支气管腔内阻塞，一般有肿瘤史、吸入异物史，发病较急，可有胸闷、气急、呼吸困难。肺栓塞（P100）（E错）可出现呼吸困难、胸痛及咯血“三联征”，呼吸系统体征以呼吸急促最常见，肺动脉瓣区第二心音亢进（P₂＞A₂）或分裂，三尖瓣区收缩期杂音。